临床上，把患者对自己的精神疾病认识和判断能力称为
A. 观察力
B. 理解力
C. 想象力
D. 自制力
E. 自知力

正确答案：E。自知力